瘀血疼痛的特征是
A. 酸痛
B. 绞痛
C. 胀痛
D. 窜痛
E. 刺痛

正确答案：E。刺痛

解析：本题考查的是瘀血的致病特点。瘀血所致疼痛多为刺痛（E对）。瘀血的致病特点：（1）疼痛：多为刺痛，痛处固定不移，拒按，夜间痛甚。（2）肿块：外伤肌肤局部，可见青紫肿胀；积于体内，久聚不散，则形成癥积，按之有痞块，固定不移。（3）出血：血色多呈紫暗色，并伴有血块。另外，临床望诊，往往还可见到面色黧黑、肌肤甲错、唇甲青紫、舌色紫暗或有瘀点、瘀斑，或舌下静脉曲张等表现。切诊则多见细涩、沉弦或结代等脉象。绞痛（B错）：指痛如绞割一样，疼痛剧烈难忍的感觉，称为绞痛。多因有形实邪闭阻气机而成，如心血瘀阻引起的真心痛，蛔虫上窜引起的脘腹痛，石淋引起的腰痛或小腹痛等，往往都具有绞痛的性质。胀痛（C错）：指疼痛伴有胀满或胀闷。多为气滞所致，在很多部位都可以出现，以胸脘、腹部为最多。如胃脘胀痛，则为中焦寒凝气滞；胸胁胀痛，则为肝郁气滞等。头部胀痛，则多见于肝阳上亢或肝火上炎的病证。酸痛（A错）与窜痛（D错）的临床意义，2022年考试指南未明确说明。